疱疹样溃疡的临床表现为
A. 单侧带状群集分布的水疱和神经痛
B. 突然发生的急性炎症，发病前有用药史
C. 有创伤史，溃疡形态往往与机械性刺激因子相吻合
D. 早期患儿损害区黏膜充血，散在色白如雪的小斑点，不久可融合成白色斑片，可继续扩大蔓延
E. 溃疡小而多，散在分布于黏膜任何部位，直径小于2mm，相近溃疡可融合成片

正确答案：E。溃疡小而多，散在分布于黏膜任何部位，直径小于2mm，相近溃疡可融合成片

解析：本题考查疱疹样溃疡的临床表现。疱疹样溃疡的临床表现为溃疡小而多，直径小于2mm，可达十个以上，散在分布于黏膜任何部位，相近溃疡可融合成片（E对）。单侧带状群集分布的水疱和神经痛（A错）为带状疱疹的临床表现。突然发生的急性炎症，发病前有用药史（B错）为药物性口炎的临床表现。有创伤史，溃疡形态往往与机械性刺激因子相吻合（C错）为创伤性溃疡的临床表现。早期患儿损害区黏膜充血，散在色白如雪的小斑点，不久可融合成白色斑片，可继续扩大蔓延（D错）为念珠菌性口炎的临床表现。